乙酰水杨酸的药理作用包括
A. 解热
B. 抗炎、抗风湿
C. 镇痛
D. 抗菌
E. 抗过敏

正确答案：A、B、C。解热；抗炎、抗风湿；镇痛